舌神经阻滞麻醉一般注射麻药量是
A. 0.1ml
B. 0.5～1ml
C. 1.5ml
D. 1.5～2ml
E. 2～3ml

正确答案：B。0.5～1ml

解析：舌神经阻滞麻醉注射方法：在行下牙槽神经麻醉口内注射后，将注射针退出1cm，此时注射麻药0.5～1ml，即可麻醉舌神经，或在退针时，边退边注射麻醉药，直到针尖退至黏膜下为止。掌握“颌面部常用局麻法及牙拔除的麻醉选择”知识点。